反映人群健康状况的生长发育统计指标是
A. 婴儿死亡率
B. 孕产妇死亡率
C. 新生儿低体重百分比
D. 患病率

正确答案：C。新生儿低体重百分比

解析：本题考查反映人群健康状况的生长发育统计指标。反映人群健康状况的生长发育统计指标有：新生儿低体重百分比（C对）、6岁以下儿童年龄别性别低身高百分比、6岁以下儿童年龄别性别低体重百分比等。婴儿死亡率（A错）、孕产妇死亡率（B错）是反映人群健康状况的死亡统计指标。患病率（D错）是反映人群健康状况的疾病统计指标。